秦艽的入药部位
A. 入药部位为根
B. 入药部位为根茎
C. 两者均是
D. 两者均不是

正确答案：A。入药部位为根

解析：本题考查的是秦艽的来源。秦艽的入药部位根（A对）。秦艽：【来源】为龙胆科植物秦艽、麻花秦艽、粗茎秦艽或小秦艽的干燥根。入药部位为根茎（B错）的中药有狗脊、黄连、升麻、北豆根、川芎、胡黄连、白术、苍术、香附、石菖蒲、黄精、玉竹、重楼、土茯苓、知母、射干、莪术、姜黄等。